蛋白质协同效应发生时可出现
A. 构象改变
B. 亚基聚合
C. 肽键断裂
D. 二硫键形成
E. 蛋白质聚集

正确答案：A。构象改变